医药生产企业销售记录至少保存
A. 三年
B. 产品有效期后一年
C. 两者都是
D. 两者都不是

正确答案：B。产品有效期后一年

解析：本题考查医药生产企业销售记录保存期限。医药生产企业销售记录至少保存产品有效期后一年（B对）。药品购进记录必须注明药品的通用名称、剂型、规格、批号、有效期、生产厂商、供货单位、购货数量、购进价格、购货日期以及国务院药品监督管理部门规定的其他内容。从药品生产企业、药品批发企业采购药品时，供货企业开具的票据应标明供货单位名称、药品名称、生产厂商、批号、数量、价格等内容的销售凭证。对留存的资料和销售凭证和购进（验收）记录等，应当按规定保存至超过药品有效期1年，但不得少于3年。